关于成人脊髓描述，错误的是
A. 脊髓上端平枕骨大孔，下端平第1腰椎体下缘
B. 外形为前后略扁粗细不均的圆柱状
C. 前正中裂浅，后正中沟深
D. 颈膨大位于第4颈节与第1胸节之间
E. 与脊髓相连的神经共有31对

正确答案：C。前正中裂浅，后正中沟深

解析：成人脊髓上端平枕骨大孔，下端平第1腰椎体下缘（A对）。外形为前后略扁粗细不均的圆柱状（B对），前正中有较深的沟称前正中裂，后正中有较浅的沟称后正中沟（C错，为本题正确答案）。脊髓在外形上没有明显的节段标志，每一对脊神经前、后根的根丝所附着的一段脊髓即是一个脊髓节段，与脊髓相连的神经共有31对（E对），故脊髓可分为31个节段，其中第4颈节与第1胸节之间（D对）脊髓呈梭形膨大，称为颈膨大。